麝香的成人一日内服量是
A. 0.01～0.015g
B. 0.03～0.1g
C. 0.2～0.5g
D. 0.6～0.8g
E. 0.9～1.5g

正确答案：B。0.03～0.1g

解析：本题考查的是麝香的用法用量。麝香的成人一日内服量是0.03～0.1g（B对）。麝香：【用法用量】内服：入丸散，0.03～0.1g，不入煎剂。外用：适量，调敷或敷贴。瓜蒂：【使用注意】本品作用强烈，易损伤正气，故孕妇、体虚、失血及上部无实邪者忌服。若呕吐不止，用麝香0.01～0.015g（A错），开水冲服可解。用量为0.2～0.5g（C错）、0.6～0.8g（D错）与0.9～1.5g（E错）的中药，2022年考试指南未明确说明。